宇宙万物的共同构成本原是
A. 元气
B. 精气
C. 神气
D. 有形之气
E. 无形之气

正确答案：B。精气

解析：该题考查中医学的哲学基础以及精气学说的内容。精，又称精气，是构成宇宙万物的本原（B对）。先天之精所化生的先天之气即元气，是人体最根本、最重要的气，是人体生命活动的原动力（A错）。